我国对生活垃圾焚烧要求燃烧温度应达到
A. 300～400℃
B. 300～700℃
C. ≥850℃
D. ≥700℃
E. ≥500℃

正确答案：C。≥850℃

解析：本题考查我国对生活垃圾焚烧燃烧温度的要求。焚烧方法是将垃圾置于高温炉内，使其可燃成分充分氧化的一种方法。垃圾经过焚烧后，体积可以减少80%～90%，是目前世界上经济发达国家广泛采用的一种城市生活垃圾处理技术。我国对生活垃圾焚烧要求燃烧温度应达到≥850℃（C对ABDE错）。